针对我国结核病疫情，首先需要控制的是
A. 活动性肺结核的高患病率
B. HIV感染增加
C. 城市人口的高感染率
D. 地区患病率差异大
E. 结核病患者的高死亡率

正确答案：A。活动性肺结核的高患病率

解析：痰涂片阳性的活动性肺结核患者是结核病在人群中的主要传染源，控制传染源是本病控制的关键，故选择控制活动性肺结核的高患病率（A对）。